心肺气虚的主要症状有
A. 久咳不已
B. 面色咣白
C. 口唇青紫
D. 气短心悸
E. 饮食减少

正确答案：A、B、C、D。久咳不已；面色咣白；口唇青紫；气短心悸